男，65岁。2周前拔除上颌剩余牙，要求全口义齿修复。检查：上颌牙槽嵴丰满，26和27拔牙窝未完全愈合，拔牙窝颊侧边缘可见明显骨尖，下颌为完整天然牙列，叩痛（-），不松动，牙周状况良好，下颌spee’s曲线曲度大，前部颌间距离约2mm，颌位关系正常。上颌骨尖修整术时机为
A. 3周后
B. 2个月后
C. 3个月后
D. 6个月后
E. 1年后

正确答案：A。3周后

解析：本题考查修复前外科处理-牙槽嵴修整术。男，65岁。2周前拔除上颌剩余牙，要求全口义齿修复。检查：上颌牙槽嵴丰满，26和27拔牙窝未完全愈合，拔牙窝颊侧边缘可见明显骨尖，下颌为完整天然牙列，叩痛（-），不松动，牙周状况良好，下颌spee’s曲线曲度大，前部颌间距离约2mm，颌位关系正常。上颌骨尖修整术时机为3周后（A对）。牙槽嵴修整术在拔牙后一个月左右实施为宜。